特纳综合征与哪项有关
A. 垂体
B. 下丘脑
C. 子宫
D. 卵巢
E. 无正确选项

正确答案：D。卵巢

解析：特纳综合征属于性腺先天性发育不全，性染色体异常，常有蹼颈、盾胸、后发际低、腭高耳低、鱼样嘴、肘外翻等临床特征，可伴主动脉缩窄及肾、骨骼畸形、自身免疫性甲状腺炎、听力下降及高血压等，表现为原发性闭经，身材矮小，第二性征发育不良，卵巢不发育，因此主要与卵巢（D对E错）有关，与垂体（A错）、下丘脑（B错）、子宫（C错）等无明显关系。